因证候禁忌不宜合用的药组是
A. 六应丸与紫雪散
B. 胆宁片与妙济丸
C. 天麻丸与苏合香丸
D. 牛黄解毒片与金匮肾气丸
E. 附子理中丸与参茸卫生丸

正确答案：D。牛黄解毒片与金匮肾气丸

解析：本题考查的是中成药联用的配伍禁忌。因证候禁忌不宜合用的药组是牛黄解毒片与金匮肾气丸（D对）。不同功效药物联用的辨证论治和禁忌：如附子理中丸与牛黄解毒片联用，附子理中丸系温中散寒之剂，适用于脾胃虚寒所致的胃脘痛、呕吐、腹泻等；而牛黄解毒片性质寒凉，为清热解毒泻火之剂，适用于火热毒邪炽盛于内而上扰清窍者，可见不加分析地盲目将两者合用是不适宜的。再如，盲目将附子理中丸与黄连上清丸、金匮肾气丸与牛黄解毒片等合用，均属不注意证候的不合理用药。六应丸与紫雪散（A错）均含丁香（母丁香），不能与含郁金的中成药联用。胆宁片与妙济丸（B错）属于含“十八反”“十九畏”药味中成药的配伍禁忌。含“十八反”“十九畏”药味中成药的配伍禁忌：现行版《中国药典》中有不宜同用药的规定，从不宜同用药的品种来看没有突破“十八反”和“十九畏”所含的品种。“十八反”“十九畏”中的药物，应属配伍禁忌，原则上是禁止应用。对于饮片处方，如果药味中含有“十八反”“十九畏”药物，那是比较容易发现的。但对于中成药，只有熟态中成药制剂的处方内容，才有可能发现此类的配伍禁忌。例如，治疗风寒湿痹证的大活络丸、尪痹冲剂、天麻丸、人参再造丸等均含有附子，而止咳化痰的川贝枇杷露、蛇胆川贝液、通宣理肺丸等分别含有川贝、半夏，依据配伍禁忌原则，若将上述两组合用，附子、乌头与川贝、半夏当属相反禁忌同用之列。利胆中成药利胆排石片、胆乐胶囊、胆宁片等都含有郁金，若与六应丸、苏合香丸、妙济丸、纯阳正气丸、紫雪散等含丁香（母丁香）的中成药同时使用，就要注意具“十九畏”药物的禁忌。临床常用中成药心通口服液、内消瘰疬丸中含有海藻，祛痰止咳颗粒含有甘遂，若与橘红痰咳颗粒、通宣理肺丸、镇咳宁胶囊等含甘草的中成药联用也属禁忌之列。天麻丸与苏合香丸（C错）：天麻丸含附子，不能与含川贝、半夏的中成药联用；苏合香丸含郁金，不能与含丁香（母丁香）的中成药联用。附子理中丸与参茸卫生丸（E错）：附子理中丸不能盲目与牛黄解毒片、黄连上清片联用；体实及阴虚火旺、感冒、脾胃虚弱者慎用参茸卫生丸。